星状神经节属于
A. 椎旁节
B. 椎前节
C. 器官旁节
D. 内脏感觉神经节
E. 躯体感觉神经节

正确答案：A。椎旁节

解析：椎旁节（A对）全长可分颈、胸、腰、骶、尾5部，星状神经节为颈胸神经节，属于椎旁节。